女性尿道的特点
A. 细短
B. 弯曲
C. 狭窄
D. 短直
E. 周围有括约肌

正确答案：D。短直

解析：女性尿道较男性尿道短、宽而直（D对），所以更发生尿路感染。